血管升压素对肾脏的主要作用是
A. 提高远曲小管和集合管对水的通透性
B. 增强髓袢升支粗段对NaCl的重吸收
C. 提高内髓部集合管对尿素的通透性
D. 促进近端小管对水重吸收
E. 保Na⁺、排K⁺，保水

正确答案：A。提高远曲小管和集合管对水的通透性